右淋巴导管注入
A. 左静脉角
B. 右静脉角
C. 乳糜池
D. 右颈干
E. 无

正确答案：B。右静脉角

解析：左静脉角为胸导管注入的地方（A错），乳糜池为胸导管起始处（C错），右颈干（D错）与右锁骨下干和右支气管纵隔干共同组成右淋巴导管而后注入右静脉角（B对）。